确诊血友病的检查是
A. 肾上腺素试验
B. 凝血活酶生成及纠正试验
C. D－二聚体测定
D. 毛细血管脆性试验
E. 血小板聚集试验

正确答案：B。凝血活酶生成及纠正试验

解析：血友病是一组因遗传性凝血活酶生成障碍引起的出血性疾病，故确诊血友病的检查是凝血活酶生成及纠正试验（B对）。肾上腺素试验（A错）可用于交感神经功能亢进、副交感神经功能亢进的鉴别；D-二聚体（C错）主要反映纤维蛋白溶解功能；毛细血管脆性试验（D错）可用于检测遗传性出血性毛细血管扩张症等疾病；血小板聚集试验（E错）主要反映血小板的聚集功能。